在梦中将自己某些不好的愿望与意念，投射于他人，而减轻对自我的谴责的是
A. 象征
B. 移置
C. 凝缩
D. 投射
E. 变形

正确答案：D。投射

解析：投射：指在梦中将自己某些不好的愿望与意念，投射于他人，而减轻对自我的谴责。掌握“心理治疗原则、主要方法及应用”知识点。